暴发型流脑脑膜炎对症治疗的关键是
A. 吸氧
B. 使用糖皮质激素
C. 退热止痉
D. 脱水降低颅内压
E. 补充血容量

正确答案：D。脱水降低颅内压

解析：暴发型流脑脑膜炎治疗关键是及早发现脑水肿，积极脱水治疗，降低颅内压，预防脑疝（D对）。可用甘露醇治疗，用法同前，此外还可使用白蛋白、甘油果糖、呋塞米、激素等药物治疗。